非水碱量法使用的指示剂是
A. 结晶紫
B. 酚酞
C. 淀粉
D. 邻二氮菲
E. 甲基红

正确答案：A。结晶紫

解析：本题考查非水溶液滴定法。非水碱量法使用的指示剂是结晶紫（A对）。酚酞（B错）可以作为酸碱滴定的指示剂。淀粉（C错）可以作为碘量法的指示剂。邻二氮菲（D错）是铈量法的指示剂。甲基红（E错）为酸碱滴定法的指示剂。